根据《中华人民共和国药品管理法》药品生产企业或其代理人给予使用其药品的医疗机构的负责人、药品采购人员、医师等有关人员以财物或其他利益的，由
A. 卫生行政部门处罚
B. 工商行政管理部门处罚
C. 经济综合主管部门处罚
D. 药品监督管理部门处罚
E. 纪检督察部门处罚

正确答案：B。工商行政管理部门处罚

解析：本题考查违反药品监督管理规定的法律责任。药品生产企业或其代理人给予使用其药品的医疗机构的负责人、药品采购人员、医师等有关人员以财物或其他利益的，由市场监督管理部门（B对）处罚。根据《药品管理法》第一百四十一条的规定，药品上市许可持有人、药品生产企业、药品经营企业或者医疗机构在药品购销中给予、收受回扣或者其他不正当利益的，药品上市许可持有人、药品生产企业、药品经营企业或者代理人给予使用其药品的医疗机构的负责人、药品采购人员、医师、药师等有关人员财物或者其他不正当利益的，由市场监督管理部门没收违法所得，并处三十万元以上三百万元以下的罚款；情节严重的，吊销药品上市许可持有人、药品生产企业、药品经营企业营业执照，并由药品监督管理部门吊销药品批准证明文件、药品生产许可证、药品经营许可证。卫生行政部门（A错）负责起草中医药事业发展的法律法规草案，指导制定中医药发展规划，推进公立医院改革等。经济综合主管部门（C错）负责经济运行监测与预测、固定资产投资管理等。药品监督管理部门（D错）负责起草食品安全、药品、医疗器械、化妆品监督管理的法律法规草案，制定食品行政许可的实施办法并监督实施等。纪检督察部门（E错）负责调查处理药品监督管理人员违反行政纪律的行为等。